麝香归心经，其作用特点是
A. 镇惊安神
B. 清心安神
C. 开窍醒神
D. 养心安神
E. 补血安神

正确答案：C。开窍醒神

解析：本题考查麝香的作用。1.理论基础（1）藏象学说所谓藏象学说，即论述人体脏腑各自的生理功能、病理变化及其相互关系的学说。它既是中医辨证论治的基础，又是中药归经的理论基础。如心主神志的生理功能出现异常，常导致失眠、多梦、神志不宁、癫狂、痴呆、健忘、昏迷等症，分别选用酸枣仁（养心安神）（D错）、远志（宁心安神）、朱砂（镇惊安神）（A错）、麝香（开窍醒神）（C对）等即可减轻或消除上述各症，就云其归心经。